用药差错是指在药物使用过程中出现的用药不当或者患者受损的
A. 不良事件
B. 可预防事件
C. 药物不良反应
D. 任何可预防事件
E. 某些可预防事件

正确答案：B。可预防事件

解析：本题考查用药差错。2011年卫生部颁布实施的《医疗机构药事管理规定》将用药错误定义为药物在临床使用全过程中出现的、任何可以防范的用药不当，是人为错误，可以防范的可预防事件（B对）。